以上名言为盖仑所述的是
A. “作为医生，不可能一方面赚钱，一方而从事伟大的艺术-医学”
B. “医生要有一切必要的知识，要洁身自持，要使患者信赖…”
C. “启我爱医术，复爱世间人”
D. “愿绝名利心，一切为病人，无分爱与憎，不问富与贫，凡诸疾病者，一视如同仁”
E. “无论贵贱贫富长幼妍媸华夷愚智，普同一等，皆如至亲之想”

正确答案：A。“作为医生，不可能一方面赚钱，一方而从事伟大的艺术-医学”

解析：古罗马名医盖伦指出“作为医生，不可能一方面赚钱，一方面从事伟大的艺术-医学”，明确了医学职业的利他性（A对）。